耐热大肠菌群的培养温度
A. 25℃
B. 30.5℃
C. 37℃
D. 44.5℃
E. 50℃

正确答案：D。44.5℃

解析：本题考查耐热大肠菌群的培养温度。耐热大肠菌群是一群在44.5℃（D对ABCE错）培养24小时，能使乳糖发酵产酸产气的细菌。它来源于人和温血动物粪便，是判断饮用水是否受粪便污染的重要微生物指标。